最易形成慢发病毒感染的病原体是
A. HIV
B. HBV
C. HAV
D. HSV
E. HPV

正确答案：A。HIV

解析：慢发病毒感染指病毒感染后，经很长的潜伏期，达数月、数年甚至数十年之久，在症状出现后呈进行性加重，最终常成为致死性感染，例如HIV、朊粒感染。掌握“病毒传播方式、感染类型、致病机制及免疫”知识点。